在下列疾病中，哪项不会导致意识障碍
A. 低血糖
B. 一度房室传导阻滞
C. 窒息
D. 一氧化碳中毒
E. 休克

正确答案：B。一度房室传导阻滞

解析：房室传导阻滞指房室交界区脱离了生理不应期后，心房冲动传导延迟或不能传到心室。一度房室传导阻滞通常不引起临床症状（B对）。二度房室传导阻滞可引起心搏脱漏、心悸等症状，也可无症状。三度房室传导阻滞可引起疲倦、乏力、头晕、晕厥等。低血糖（A错）指各种原因引起的成年人空腹血糖浓度低于2.8mmol/L，通常可引起出汗、饥饿等，严重者可导致躁动、意识障碍等。窒息（C错）指各种原因引起的呼吸受阻或异常，严重窒息可导致意识障碍。一氧化碳中毒（D错）指含碳化合物不完全燃烧产物经呼吸道吸入引起的中毒现象，可引起恶心、呕吐、意识障碍甚至死亡等。休克（E错）指有效循环血量减少，机体失代偿，可引起血压减低、意识障碍、多器官衰竭等。